患者，男，65岁，诊断为持续性心房颤动，医生处方胺碘酮和华法林治疗。患者既往有高血压、糖尿病、冠心病和高脂血症，目前正在服用贝那普利、美托洛尔、二甲双胍、阿卡波糖、辛伐他汀等药物治疗。根据患者用药情况，药师提出的合理化药物治疗建议，不包括
A. 患者在复律成功后，尽可能以最小的胺碘酮剂量维持治疗
B. 因为胺碘酮和贝那普利存在临床意义的相互作用，建议换成氨氯地平等CCB降压药
C. 胺碘酮可以显著抑制CYP2D6，减慢美托洛尔的代谢，应该根据患者心率和血压调整美托洛尔剂量
D. 胺碘酮能增加华法林的抗凝活性，在逐渐降低胺碘酮剂量的时候，注意随时根据INR值调整华法林的剂量
E. 胺碘酮和辛伐他汀存在临床意义的相互作用，合用时应该限制辛伐他汀的日剂量（不超过20mg/天）

正确答案：B。因为胺碘酮和贝那普利存在临床意义的相互作用，建议换成氨氯地平等CCB降压药

解析：本题考查药物的合理应用。因为胺碘酮和贝那普利存在临床意义的相互作用，建议换成氨氯地平等CCB降压药（B错，为本题正确答案）。胺碘酮为肝药酶抑制剂，减少药物的代谢，换成CCB类降压药没任何意义。患者在复律成功后，尽可能以最小的胺碘酮剂量维持治疗（A对）。胺碘酮可以显著抑制CYP2D6，减慢美托洛尔的代谢，应该根据患者心率和血压调整美托洛尔剂量（C对）。胺碘酮能增加华法林的抗凝活性，在逐渐降低胺碘酮剂量的时候，注意随时根据INR值调整华法林的剂量（D对）。胺碘酮和辛伐他汀存在临床意义的相互作用，合用时应该限制辛伐他汀的日剂量（不超过20mg/天）（E对）。